金匮肾气丸适用于
A. 风寒闭肺喘证
B. 痰热郁肺喘证
C. 肾虚作喘喘证
D. 肺脾两虚喘证
E. 肺肾阴虚喘证

正确答案：C。肾虚作喘喘证

解析：本题考查的是喘证的辨证论治。金匮肾气丸适用于肾虚作喘喘证（C对）。肾虚作喘喘证可用金匮肾气丸治疗。用金匮肾气丸治疗肾虚作喘，但若久治不愈，阳损及阴，兼见咽干烦躁者，又当配麦味地黄丸、生脉散或参蛤散同用，以平调阴阳、纳气平喘，且防止金匮肾气丸燥烈伤阴，降低副作用。喘即气喘、喘息。喘证是以呼吸困难，甚至张口抬肩、鼻翼扇动、不能平卧为特征的疾病。西医学的肺炎、支气管炎、肺气肿、肺源性心脏病、心源性哮喘以及癔病等发生呼吸困难时，可参考此内容辨证论治。（一）风寒闭肺证（A错）：【中成药应用】常用中成药有小青龙胶囊、风寒咳嗽颗粒、苓桂咳喘宁胶囊、桂龙咳喘宁胶囊。（二）痰热壅肺证（B错）：【中成药应用】常用中成药有清肺消炎丸、葶贝胶囊。（三）痰浊阻肺证：【中成药应用】常用中成药有橘红痰咳颗粒、祛痰止咳颗粒。（四）肾不纳气证：【中成药应用】常用中成药有补金片。肺脾两虚证（D错）与肺肾阴虚证（E错）临床常见咳嗽，而不是喘证。肺脾两虚证的临床表现，常见久咳不已，短气乏力，痰多清稀，食纳减少，腹胀便溏，甚则足面浮肿，舌淡苔白，脉细弱。一般以咳喘、纳少、腹胀便溏为主，伴见气虚症状为辨证要点。肺肾阴虚证的临床表现，常见咳嗽痰少，动则气促，间或咯血，腰膝酸软，消瘦，骨蒸潮热，盗汗遗精，颧红，舌红苔少，脉细数。